基础代谢率低于正常范围的疾患是
A. 白血病
B. 库欣综合征
C. 垂体性肥胖症
D. 中暑
E. 糖尿病

正确答案：C。垂体性肥胖症

解析：基础代谢率指在基础状态下单位时间内单位体表面积的能量代谢。基础代谢率增高，见于甲亢、糖尿病（E错）、库欣综合征（B错）、红细胞增多症、白血病（A错）、伴有呼吸困难的心脏病等；基础代谢率降低，见于甲减、肾上腺皮质功能减退、垂体性肥胖（C对）、肾病综合症、病理性饥饿等。中暑的过程不单一，细胞代谢的变化也不是单一的增高或降低，所以中暑（D错）无法笼统的判断基础代谢率的高低。